男，75岁。排尿困难4年，夜尿4~5次。直肠指检可触及前列腺增生Ⅲ°。B超可查残余尿220ml，双肾中度积水，血Cr360umol/L，尿常规：白细胞20~30个/HP，此患者目前选择哪项治疗方法最佳
A. 经耻骨后前列腺切除术
B. 膀胱造瘘术
C. 留置导尿
D. 药物治疗
E. 经膀胱前列腺切除术

正确答案：C。留置导尿

解析：老年男性，排尿困难4年，夜尿4~5次（尿频是前列腺增生最常见的早期症状）。直肠指检可触及前列腺增生Ⅲ°。B超可查残余尿220ml，双肾中度积水，血Cr360umol/L，尿常规：白细胞20~30个/HP，考虑为前列腺增生所导致的尿潴留、肾积水和肾功能不全，此时应该引流尿液以缓解尿潴留症状，故答案选择留置导尿（C对）。膀胱造瘘术（B错）主要用于插入导尿管失败的患者。